下列有关药历的叙述，正确的是
A. 与病历相同，是由医师填写的
B. 药师为患者建立的用药档案
C. 是患者病危抢救时的用药记录
D. 可用作患者退药的唯一依据
E. 不能干预医师的药物治疗方案

正确答案：B。药师为患者建立的用药档案

解析：本题考查药历。药历是药师进行规范化药学服务的具体体现，是药师以药物治疗为中心，发现、分析和解决药物相关问题的技术档案（B对）。药历是由药师填写的（A错）。药历包括用药记录但是不等于用药记录（C错）。药历不是患者退药的唯一依据（D错）。药历包括用药评价，其中又包括药学干预内容、药物治疗建设性意见等（E错）。